在一般条件下，下列哪类冠桩固位最好
A. 光滑柱形
B. 槽柱形
C. 铸造冠桩
D. 螺纹桩
E. 弯制冠桩

正确答案：D。螺纹桩

解析：本题考查桩的形状与表面结构。桩的形态主要有柱形桩核锥形桩。根据桩的表面形态又可分为光滑柱形、曹柱形、锥形、螺纹形等。螺纹桩（D对）可以旋转嵌入根管内壁产生主动固位，固位最好。光滑柱形（A错）、槽柱形（B错）、铸造冠桩（C错）、弯制冠桩（E错）都是被动就位，较之主动就位，固位力差些。